患儿，男，3岁。面色萎黄，形体消瘦，时有口干腹胀，不思饮食，烦躁啼哭，毛发稀疏，大便如米泔，舌苔黄腻，脉细。治疗应首选
A. 下脘、足三里、四缝、商丘
B. 上脘、三阴交、太冲、解溪
C. 下脘、中脘、上脘、内庭
D. 下脘、上脘、四缝、足三里
E. 中脘、合谷、曲池、四缝

正确答案：A。下脘、足三里、四缝、商丘

解析：本题考查常见的病症的辩证、处方。题中男，3岁，面色萎黄，形体消瘦，时有口干腹胀，不思饮食，烦躁啼哭，毛发稀疏，大便如米泔，舌苔黄腻，脉细，可辩证为疳疾。下脘、足三里、四缝、商丘等穴合用可用于治疗慢性疾病疳疾（A对）。上脘、三阴交、太冲、解溪合用可用于治疗肝部疾病（B错）。下脘、中脘、上脘、内庭合用可用于治疗胃脘部病变（C错）。下脘、上脘、四缝、足三里合用可用于肠道疾病病症（D错）。中脘、合谷、曲池、四缝合用可用于治疗口腔炎等病症（E错）。